患儿，2岁。半年来经常泄泻，形神疲惫，面色萎黄，大便稀薄，四肢不温，时有抽搐。其证候是
A. 外感惊风
B. 痰食惊风
C. 脾肾阳虚
D. 土虚木亢
E. 阴虚风动

正确答案：D。土虚木亢

解析：题中患儿半年来长期泄泻，以形神疲惫，面色萎黄，大便稀薄，四肢不温，时有抽搐为主症，符合慢惊风的诊断。外感惊风为急惊风，且为实证（A错）。痰食惊风为外感惊风，且为实证（B错）。慢惊风脾肾阳虚多伴面白无华，口鼻气冷，四肢厥冷，溲清便溏，手足蠕动震颤（C错）。长期泄泻致脾虚，脾虚不能制约肝而动风，出现抽搐，故为脾虚肝旺证，即土虚木亢证（D对）。慢惊风阴虚风动证多伴虚烦低热，手足心热，大便干结，肢体拘挛或强直，抽搐时轻时重（E错）。